有关唾液的体液的调节作用说法错误的是
A. 夏季较多，冬季较少
B. 与季节变化有关
C. 出汗时，体内水分减少
D. 腹泻时，血浆渗透压升高
E. 腹泻时，体内水分减少

正确答案：A。夏季较多，冬季较少

解析：唾液的体液的调节作用：当出汗、腹泻时，体内水分减少，血浆渗透压升高，此时唾液的分泌量则减少，以调节体液量。唾液的分泌还与季节变化有关，夏季较少，冬季较多。掌握“唾液的分泌和功能”知识点。